各类片剂压片前需加入
A. 黏合剂
B. 润湿剂
C. 吸收剂
D. 润滑剂
E. 稀释剂

正确答案：D。润滑剂

解析：本题考查的是片剂辅料的适用范围。各类片剂压片前需加入润滑剂（D对）。润滑剂：压片前必须加入的，能增加颗粒（或粉末）流动性，减少颗粒（或粉末）与冲模内摩擦力，具有润滑作用的物料。常用的润滑剂有硬脂酸镁、滑石粉、聚乙二醇、月桂醇硫酸镁（钠）、微粉硅胶。黏合剂（A错）：本身具有黏性，能增加药粉间的黏合作用，以利于制粒和压片的辅料。常用的黏合剂有淀粉浆（糊）、糖浆、胶浆类、微晶纤维素、纤维素衍生物等。润湿剂（B错）：本身无黏性，但能润湿并诱发药粉黏性的液体。适用于具有一定黏性的药料制粒压片。常用的湿润剂有水、乙醇等。吸收剂（C错）：适用于原料药（含中间体）中含有较多挥发油、脂肪油或其他液体，而需制片者。常用的吸收剂有淀粉、硫酸钙二水物、磷酸氢钙等。稀释剂（E错）：适用于主药剂量小于0.1g，或浸膏黏性太大，或含浸膏量多而制片困难者。常用的稀释剂有淀粉、糊精、糖粉、甘露醇、硫酸钙二水物等。